国家实行医师资格考试制度，目的是检查评价申请医师资格者是否具备
A. 医学专业学历
B. 取得医学专业技术职务的条件
C. 从事医学专业教学科研的资格
D. 开办医疗机构的条件
E. 从事医学实践必需的基本专业知识与能力

正确答案：E。从事医学实践必需的基本专业知识与能力

解析：国家实行医师资格考试制度，目的是检查评价申请医师资格者是否具备从事医学实践必需的基本专业知识与能力（E对）。